Black分类法是依据
A. 龋坏范围
B. 窝洞所在牙面
C. 龋坏所在部位和制洞特点
D. 以上都不是

正确答案：C。龋坏所在部位和制洞特点

解析：本题考查Black分类法。Black分类法是依据龋坏所在部位和制洞特点进行分类（C对），可分为五类。BlackⅠ类洞：所有牙面发育点隙裂沟的龋损所备成的窝洞。BlackⅡ类洞：后牙邻面的龋损所备的窝洞。BlackⅢ类洞：前牙邻面未累及切角的龋损所备成的窝洞。BlackⅣ类洞：前牙邻面累及切角的龋损所备成的窝洞。BlackⅤ类洞：所有牙齿颊（唇）舌面颈1/3处的龋损所备成的窝洞。